某女，42岁。患白带增多、阴部瘙痒半年，医生诊为湿热下注，处以内服中药并外用妇必舒阴道泡腾片，妇必舒阴道泡腾片的处方组成为苦参、蛇床子、大黄、百部、乌梅、硼砂、冰片、白矾、甘草，据文献报道该阴道泡腾片有抗菌消炎作用。妇必舒阴道泡腾片处方中具有抗病原体作用的双稠哌啶类化合物的饮片是
A. 苦参
B. 乌梅
C. 大黄
D. 百部
E. 蛇床子

正确答案：A。苦参

解析：本题考查的是苦参化学成分的结构类型。妇必舒阴道泡腾片处方中具有抗病原体作用的双稠哌啶类化合物的饮片是苦参（A对）。苦参中的主要生物碱苦参碱和氧化苦参碱等都属于双稠哌啶类生物碱。苦参总生物碱具有抗肿瘤、抗病原微生物、抗心律失常、解热、抗炎、抗变态反应和调节免疫等作用。